女，28岁。停经68天，阵发腹痛伴多量阴道流血1天，妇科检查：子宫6周妊娠大小，宫口开，有血液不断流出，处理首选的是
A. 立即清宫
B. 立即抗感染
C. 按摩子宫
D. 输血
E. 剖腹探查

正确答案：A。立即清宫

解析：育龄期女性，停经68天，阵发腹痛伴多量阴道流血（流产的典型临床表现主要为停经后阴道流血和阵发腹痛），妇科检查：子宫6周妊娠大小（不全流产时部分妊娠物排出宫腔，子宫小于停经周数），宫口开大，有血液不断流出（不全流产时，宫口已扩张，部分妊娠物残留于宫腔内或崁顿于宫颈口，或胎儿排出后胎盘滞留宫腔或崁顿于宫颈口，影响子宫收缩，导致大量出血，甚至休克），应诊断为不全流产。不全流产一经确诊，处理首选的是立即清宫（A对），清除宫内残留组织。若阴道出血量大并伴有休克，应同时输液、输血（D错），给予抗生素预防感染（B错）。按摩子宫（P213）（C错）适用于子宫收缩乏力引起的产后出血，可加强宫缩，迅速止血。剖腹探查（E错）适用于异位妊娠破裂腹腔内出血。